中西药联用能降低西药不良反应的药组是
A. 龙骨与洋地黄类药
B. 刺五加与化疗药
C. 洋金花与强心苷类药
D. 复方枇杷糖浆与降压药
E. 五味子糖浆与磺胺类药

正确答案：B。刺五加与化疗药

解析：本题考查的是中西药合理联用的例举。中西药联用能降低西药不良反应的药组是刺五加与化疗药（B对）。黄芪、人参、女贞子、刺五加、当归、山茱萸等，与西药化疗药联用，可降低患者因化疗药而导致的白细胞降低等不良反应。龙骨与洋地黄类药（A错）联用增加不良反应。含钙较多的中药或中成药，如石膏、龙骨、牡蛎、珍珠、蛤壳及瓦楞子等，不可与洋地黄类药物合用，因钙离子为应激性离子，能增强心肌收缩力，抑制Na⁺，K⁺-ATP酶活性（也可以说与强心苷有协同作用），从而增强洋地黄类药物的作用和毒性。洋金花与强心苷类药（C错）联用增加不良反应。含颠茄类生物碱的中药及其制剂，如曼陀罗、洋金花、天仙子、颠茄合剂等；含有钙离子的中药，如石膏、牡蛎、龙骨等，均不可与强心苷类药物联用，因颠茄类生物碱可松弛平滑肌，降低胃肠道的蠕动，与此同时也就增加了强心苷类药物的吸收和蓄积，故增加了毒性。复方枇杷糖浆与降压药（D错）联用增加不良反应。含麻黄碱的中药及其中成药，如复方川贝精片、莱阳梨止咳糖浆、复方枇杷糖浆等，不可与强心药、降压药联用。因麻黄碱会兴奋心肌β受体、加强心肌收缩力，与洋地黄、地高辛等联用时，可使强心药的作用增强，毒性增加，易致心律失常及心衰等毒性反应，同时麻黄碱也有兴奋α受体和收缩周围血管的作用，使降压药作用减弱，疗效降低，甚至使血压失去控制，可加重高血压患者的病情。五味子糖浆与磺胺类药（E错）联用降低药物疗效。酸性较强的中药，如山楂、五味子、山茱萸、乌梅及中成药五味子糖浆、山楂冲剂等，不可与磺胺类药物联用。因磺胺类药物在酸性条件下不会加速乙酰化的形成，从而失去抗菌作用。